心力衰竭的防治原则是
A. 防治原发病
B. 消除诱因
C. 改善心脏泵血功能
D. 干预心肌重建
E. 以上都是

正确答案：E。以上都是

解析：心力衰竭是一种进行性病变，需要长期控制管理。防治原则包括：防治可能导致心力衰竭发生的原发病（A对）、消除诱因（B对）以延缓心衰的加重、改善心脏泵血功能（C对）、干预心肌重建（D对）、调节神经-体液系统失衡、减轻心脏负荷。A、B、C、D选项均为心力衰竭防治原则，因而E选项为本题正确答案。